无副交感神经分布
A. 汗腺
B. 下颌下腺
C. 泪腺
D. 腮腺
E. 舌下腺

正确答案：A。汗腺

解析：交感神经主要分布于全身血管、腺体、竖毛肌等，一般认为大部分血管、汗腺（A对）、竖毛肌、肾上腺髓质只接受交感神经支配。